成组四格表资料采用基本公式或专用公式计算不校正χ²值的条件是
A. 所有的理论频数均大于5
B. 样本总例数大于40，且只有一个理论频数小于5
C. 样本总例数大于40，且最小的理论频数大于5
D. 样本总例数小于40，且最小理论频数大于5
E. 两个样本率均大于5％

正确答案：C。样本总例数大于40，且最小的理论频数大于5